甲状腺功能亢进症的临床表现包括
A. 声音嘶哑、毛发稀疏、眉毛外端1/3脱落
B. 多食、消瘦、多汗、激动等高代谢症候群
C. 神经和血管兴奋性增强，如心悸、手颤
D. 不同程度的突眼和甲状腺肿大等特征性体征
E. 少数老年患者可表现为乏力、体重明显减轻，称为”淡漠型甲亢”

正确答案：B、C、D、E。多食、消瘦、多汗、激动等高代谢症候群；神经和血管兴奋性增强，如心悸、手颤；不同程度的突眼和甲状腺肿大等特征性体征；少数老年患者可表现为乏力、体重明显减轻，称为”淡漠型甲亢”

解析：本题考查甲状腺功能亢进症的临床表现。甲状腺功能亢进症的临床表现主要有：（1）多食、消瘦、多汗、激动等高代谢症候群（B对）。（2）神经和血管兴奋性增强，如心悸、手颤（C对）。（3）不同程度的甲状腺肿大和突眼等特征性体征（D对）。（4）可伴发周期性瘫痪和近端肌肉进行性无力、萎缩。（5）严重者可出现甲状腺危象、昏迷甚至危及生命。（6）少数老年患者高代谢症状不典型，而仅表现为乏力、心悸、厌食、抑郁、嗜睡、体重明显减轻，称为“淡漠型甲亢”（E对）。声音嘶哑、毛发稀疏、眉毛外端1/3脱落（A错）是甲状腺功能减退症的临床表现。